患者，男，56岁。患慢性支气管炎10余年，近日来咳嗽加重，气急，胸部胀闷，咳痰稀薄色白，恶寒，舌苔薄白，脉浮。其治法是
A. 燥湿化痰
B. 温肺化饮
C. 补肺益气
D. 补脾益肺
E. 清肺化痰

正确答案：B。温肺化饮

解析：患者为中年男性，患慢性支气管炎10余年，近日出现咳嗽加重，气急，胸部胀闷，咳痰稀薄色白，说明是寒象，又恶寒，舌苔薄白，脉浮，均为寒证的表现，故辨证为寒饮伏肺证，治宜温肺化饮，散寒止咳（B对）。